下列哪些物质是氯化副产物
A. 氯仿、酸性氯化呋喃酮
B. 卤化氢、氯化氢
C. 酸性氯化呋喃酮、环已烷
D. 卤乙氢、氯化钾
E. 二氯化氢、溴仿

正确答案：A。氯仿、酸性氯化呋喃酮

解析：本题考查氯化消毒副产物。氯化消毒副产物系指在氯化消毒过程中的氯与水中有机物反应所产生的卤代烃类化合物。最常见的氯化消毒副产物有挥发性卤代有机物和非挥发性卤代有机物两大类。本题中氯仿、酸性氯化呋喃酮（A对BCDE错）属于氯化消毒副产物。它们是一种无色的液体，具有刺激性气味，可以用来制备氯化物